下列哪种酶可催化PIP₂水解IP₃
A. 磷脂酶A1
B. 磷脂酶C
C. PKA
D. PKC
E. 磷脂酶A2

正确答案：B。磷脂酶C